患者女性，54岁。白带增多，均匀稀薄，有臭味，阴道黏膜无明显充血，阴道pH值为5。最可能的诊断是
A. 细菌性阴道病
B. 滴虫阴道炎
C. 老年性阴道炎
D. 急性淋病
E. 念珠菌阴道炎

正确答案：A。细菌性阴道病